维生素A缺乏最早临床表现是
A. 暗适应时间延长
B. 夜盲症
C. 毕脱氏斑
D. 毛囊角化皮肤干燥
E. 毛囊丘疹与毛发脱落

正确答案：A。暗适应时间延长

解析：维生素A缺乏，眼部病变为首先发生暗适应时间延长（A对），严重时会发生“夜盲症”（B错）、毕脱氏斑（维生素A严重缺乏时，在球结膜上发现的干燥斑）（C错）和失明。维生素A缺乏皮肤典型症状是干燥、粗糙脱屑，重者可表现为毛囊角化皮肤干燥（D错）和毛囊丘疹与毛发脱落（E错），在丘疹密集处状如蟾皮。